下列各项中，属于乙类传染病学的是
A. 风疹
B. 流行性感冒
C. 霍乱
D. 鼠疫
E. 传染性非典型肺炎

正确答案：E。传染性非典型肺炎

解析：乙类包括：传染性非典型肺炎（严重急性呼吸综合征）（E对）、艾滋病、病毒性肝炎、脊髓灰质炎、人感染高致病性禽流感、麻疹、肾综合征出血热、狂犬病、流行性乙型脑炎、登革热、炭疽、细菌性和阿米巴痢疾、肺结核、伤寒和副伤寒、流行性脑脊髓膜炎、百日咳、白喉、新生儿破伤风、猩红热、布鲁菌病、淋病、梅毒、钩端螺旋体病、血吸虫病、疟疾。肠道传染病包括细菌引起的细菌性痢疾、伤寒、副伤寒、霍乱、霍乱以及食物中毒等；阿米巴原虫引起的阿米巴痢疾；相关病毒引起的病毒性肝炎、脊髓灰质炎（小儿麻痹）等。风疹（A错）、流行性感冒（B错）属于丙类传染病。霍乱（C错）、鼠疫（D错）属于甲类传染病。